含有γ-氨基丁酸结构，口服吸收良好的药物是
A. 苯巴比妥
B. 苯妥英钠
C. 加巴喷丁
D. 卡马西平
E. 丙戊酸钠

正确答案：C。加巴喷丁